因功能不同，联用可互补治疗兼证的药组是
A. 更衣丸与内消瘰疬丸
B. 六味地黄丸与补中益气丸
C. 急支糖浆与珍菊降压片
D. 银黄片与双黄连口服液
E. 镇咳宁胶囊与心通口服液

正确答案：B。六味地黄丸与补中益气丸

解析：本题考查的是中成药的配伍使用。因功能不同，联用可互补治疗兼证的药组是六味地黄丸与补中益气丸（B对）。中成药之间的配伍应用为明清以来的历代医家广泛采用，如明·薛己以补中益气丸、味地黄丸合用治疗气阴不足；清·叶天士以大补阴丸、水陆二仙丹、牡蛎全樱膏配伍同用治疗阴虚火旺、淋浊、早泄。由此可见中成药之间的配伍应用，自古以来就是临床应用中成药的主要形式之一。临床常用中成药心通口服液、内消瘰疬丸中含有海藻，祛痰止咳颗粒含有甘遂，若与橘红痰咳颗粒、通宣理肺丸、镇咳宁胶囊（E错）等含甘草的中成药联用也属禁忌之列。